转运游离脂肪酸的是
A. 免疫球蛋白
B. 肌红蛋白
C. 脂蛋白
D. 铜蓝蛋白
E. 清（白）蛋白

正确答案：E。清（白）蛋白

解析：转运游离脂肪酸的是清（白）蛋白（E对），它能将脂肪酸运送至全身。免疫球蛋白（A错）又称为抗体，在人体的体液免疫中起主要作用。肌红蛋白（B错）是一种氧结合血红素蛋白，主要分布于心肌和骨骼肌中。脂蛋白（C错）是血浆脂类物质与载脂蛋白结合后形成的，脂蛋白是脂类物质在血浆中的运输形式。铜兰蛋白（P104）（D错）又称铜氧化酶，它可以催化Fe²⁺氧化为Fe³⁺。